口腔颌面部因炎症而引起的牙源性囊肿主要是
A. 根尖囊肿
B. 鼻腭囊肿
C. 鼻唇囊肿
D. 始基囊肿
E. 含牙囊肿

正确答案：A。根尖囊肿

解析：根尖囊肿是颌骨内最常见的牙源性囊肿，属于炎症性囊肿。有Malassez上皮剩余增殖以及增值上皮团块中央液化、囊性病变等一系列病理过程。因此常发生于死髓牙的根尖部。而鼻腭囊肿、鼻唇囊肿属于非牙源性囊肿。而含牙囊肿也可继发感染，但是属于发育性牙源性囊肿。掌握“牙源性颌骨囊肿”知识点。